一患者戴用全口义齿，主诉经常咬舌，无其他不适，检查发现：两侧后牙（牙合）面低，排列偏舌侧。最好的处理是
A. 自凝加高旧义齿（牙合）面
B. 调颌下后牙舌尖
C. 调颌下后牙舌面
D. 磨低上后牙舌尖
E. 重做，矫正后牙位置

正确答案：E。重做，矫正后牙位置

解析：如果由于后牙排列覆盖过小，出现咬颊或咬舌时，可磨改上颌后牙颊尖舌侧斜面和下后牙颊尖的颊侧斜面，加大覆盖，解决咬颊现象。咬舌，可磨改上颌后牙舌尖舌侧斜面和下后牙舌尖颊侧斜面。题干提示后牙排列偏舌侧，不属于后牙排列覆盖过小的问题。这种情况调磨效果不佳，一般需要重做。掌握“全口义齿戴入后问题及处理”知识点。